男性，17岁。感冒一周后出现颜面及双下肢浮肿。查体：血压140/90mmHg，颜面及双下肢轻度浮肿。尿常规：蛋白++，红细胞+。Scr176μmol/L，补体C3轻度下降。诊断为急性肾小球肾炎。下列哪类药物不宜使用
A. 利尿剂
B. 血管紧张素转换酶抑制剂
C. 血管紧张素Ⅱ受体拮抗剂
D. 糖皮质激素
E. 钙离子拮抗剂

正确答案：D。糖皮质激素

解析：患者已诊断为急性肾小球肾炎，该病为自限性疾病，不宜使用糖皮质激素治疗（D错，为本题正确答案），因糖皮质激素可降低患者的免疫力，不利于患者的恢复。急性肾小球肾炎的治疗原则是一般治疗（急性期应卧床休息，待症状消失后逐渐增加活动量，限制盐和蛋白质摄入），治疗感染灶，对症治疗（利尿消肿、降血压、预防心脑并发症的发生），透析治疗（发生急性肾衰竭而有透析指征时）。利尿剂（A对）、血管紧张素转换酶抑制剂（B对）、血管紧张素Ⅱ受体拮抗剂（C对）、钙离子拮抗剂（E对）均为降血压的对症治疗。